容易产生无基釉的冠修复体边缘设计形式是
A. 刃状
B. 斜面
C. 凹槽
D. 带斜坡肩台
E. 直角肩台

正确答案：C。凹槽

解析：本题考查修复体龈边缘外形的选择应用。容易产生无机釉的冠修复体边缘设计形式是凹槽（C对）。1.凹槽边缘的优点是边缘清晰、厚度合适、容易控制掌握；缺点是可能形成无基釉边缘。2.刃状（A错）边缘的优点是保存牙体组织较多；缺点是边缘位置难确定。3.斜面（B错）边缘的优点是防止产生无基釉；缺点是限于金属材料。4.肩台（DE错）边缘的优点是边缘强度好；缺点是磨牙多。